具有“喜燥恶湿”特性的脏腑是
A. 肝
B. 脾
C. 胃
D. 肾
E. 肺

正确答案：B。脾

解析：肝（A错）的生理特性主要有肝气升发与肝为刚脏。胃（C错）具有喜润而恶燥的生理特性，与脾喜燥恶湿（B对）相对而言。肾（D错）的生理特性是主蛰守位与肾气上升。肺（E错）的生理特性主要有肺为华盖、肺为娇脏与肺气宣降。